行于脉外的是
A. 宗气
B. 元气
C. 营气
D. 卫气
E. 中气

正确答案：D。卫气

解析：本题考查的是气的分类与分布。行于脉外的是卫气（D对）。人体之气，由于生成来源、分布部位及功能特点的不同，而有着各自不同的名称。1.元气（B错）：又称“原气”，是人体最基本、最重要的气，是人体生命活动的原动力。元气主要由先天之精化生而来，并受后天水谷之精气的不断补充和培育。可见，元气的盛衰，不仅决定于先天之禀赋，亦与脾胃运化水谷精气的功能密切相关。元气根于肾，通过三焦而流行于全身，内至脏腑，外达肌肤腠理。2.宗气（A错）：是积于胸中之气。宗气在胸中集聚之处，称作“气海”，又称“膻中”。宗气由肺吸入的清气和脾胃运化产生的水谷精气相互结合而生成。因此，肺的呼吸功能与脾胃的运化功能正常与否，直接影响着宗气的盛衰。宗气聚集于胸中，向上分布于肺与息道，向下贯注于心脉，布散全身。3.营气（C错）：又称“荣气”，与卫气相对而言，营气行于脉内而属阴，故又有“营阴”之称。主要来源于脾胃所运化的水谷精气，由水谷精气中的精华部分所化生。水谷精微中的精华部分，是营气的主要成分，是脏腑、经络等生理活动的主要营养物质。4.卫气：与营气相对而言，卫气行于脉外而属阳，又称“卫阳”。卫气主要由水谷精气所化生，运行于脉外。卫气活动力特别强，流动迅速，故不受脉管的约束，可运行于皮肤、分肉之间，布散于全身内外上下。中气（E错），2022年考试指南未明确说明。